血栓转归中不会发生的是
A. 钙化
B. 溶解
C. 化生
D. 机化
E. 形成栓子

正确答案：C。化生

解析：血栓转归的结果有：①软化、溶解（B对）和吸收。小的新鲜血栓可被迅速完全溶解，但较大的血栓多为部分溶解，可随血液运行到管腔较细的血管中停留，形成血栓栓子（E对）。②机化（D对）和再通。③钙化（A对）。化生（P9）（C错，为本题正确答案）是指一种分化成熟的细胞类型被另一种分化成熟的细胞类型所取代的过程，与血栓转归无关。